城市环境噪声的来源有
A. 交通噪声、工业噪声、建筑施工噪声
B. 交通噪声、工业噪声
C. 建筑施工噪声、社会噪声
D. B＋C
E. A＋B＋C

正确答案：D。B＋C

解析：本题考查城市环境噪声的来源。城市环境噪声的来源有：1.交通噪声：机动车辆、铁路机车、机动船舶及航空运输器等交通运输工具在运行中产生的噪声；2.工业噪声：工矿企业在生产过程中机械设备运转产生的噪声；3.建筑施工噪声：建筑施工现场各种不同性能的动力机械产生的噪声；4.社会生活噪声：人为活动产生的噪声。包括文化娱乐场所和商业经营活动中使用的设备、设施产生的噪声，建筑物配套的服务设施产生的噪声，街道、广场等公共活动场所产生的噪声以及家庭生活活动产生的噪声等。